法洛氏四联症患者主要出现：
A. 低张性缺氧
B. 血液性缺氧
C. 循环性缺氧
D. 组织中毒性缺氧
E. 以上都不对

正确答案：A。低张性缺氧

解析：法洛氏四联症患者，由于其右心的压力高于左心，未经氧合的静脉血掺入左心的动脉血中，导致 Pa02和血氧含量降低，符合低张性缺氧（A对）的血氧变化特点。